直接抑制Xa因子，阻断凝血酶原转化为凝血酶，但不影响已形成的凝血酶活性的药物是
A. 替格瑞洛
B. 华法林
C. 利伐沙班
D. 达比加群酯
E. 替罗非班

正确答案：C。利伐沙班

解析：本题考查药物作用机制及分类。利伐沙班（C对）可直接抑制Xa因子，阻断凝血酶原转化为凝血酶，但不影响已形成的凝血酶活性。替格瑞洛（A错）能可逆性地与血小板P2Y12ADP受体相互作用，阻断信号传导和血小板活化。华法林（B错）具有竞争性对抗维生素K的作用，具有抗凝和抗血小板聚集功能。达比加群酯（D错）与凝血酶上的纤维蛋白原结合位点结合，阻止纤维蛋白原转化为纤维蛋白，抑制游离凝血酶、已与纤维蛋白结合的凝血酶和凝血酶诱导的血小板聚集。替罗非班（E错）是一种非肽类的血小板糖蛋白Ⅱb/Ⅲa受体的可逆性拮抗剂，阻止纤维蛋白原与糖蛋白Ⅱb/Ⅲa结合，从而阻断血小板的交联及血小板的聚集。